根据《中国成人超重和肥胖症预防控制指南》，体重指数（BMI）判断为肥胖的标准是
A. BMI≤18.5
B. BMI≥28.0
C. BMI≤21.5
D. BMI≥24.0
E. BMI≥25.0

正确答案：B。BMI≥28.0

解析：本题考查体重指数。根据《中国成人超重和肥胖症预防控制指南》，体重指数（BMI）判断为肥胖的标准是BMI≥28.0（B对）。体重指数BMI＜18.5（A错）位体重过低，BMI18.5～23.9（C错）为体重正常；BMI24～27.9（DE错）为超重；BMI≥28为肥胖。